男，37岁。1周来咳嗽、寒战、高热，最高体温40℃。血WBC15.2×10⁹/L，N0.91，经阿莫西林抗感染治疗后体温下降不明显，逐渐出现呼吸急促。半月前颈部皮肤疖肿，自行结痂，胸部X线片示双肺可见多发直径2～3cm的边缘模糊的类圆形阴影，其内可见空洞。下列检查对明确诊断意义最大的是
A. 痰涂片革兰染色
B. 支气管镜
C. 动脉血气分析
D. 胸部CT
E. 血培养

正确答案：E。血培养

解析：患者为中年男性，1周来咳嗽、寒战、高热，最高体温40℃，血WBC15.2×10⁹/L（正常值4～10×10⁹），N0.91（正常值0.4～0.75），血象偏高提示感染征象，胸部X线片示双肺可见多发直径2～3cm的边缘模糊的类圆形阴影，其内可见空洞（为肺脓肿的典型临床表现），提示肺脓肿，患者半月前颈部皮肤疖肿，根据其临床表现和辅助检查，提示血源性肺脓肿可能很大，其致病菌以金黄色葡萄球菌、表皮葡萄球菌及链球菌为常见，因此血培养（E对）阳性时对病原体的诊断价值更大，最有助于确诊该病。痰涂片革兰染色（A错）的阳性率低，且痰标本易被污染，对明确诊断意义不大。支气管镜（B错）有助于明确病因和病原学诊断，并可用于治疗，但不是确诊的首选检查。动脉血气分析（C错）主要用于呼吸衰竭、酸碱平衡紊乱等疾病的诊断。胸部CT（D错）多用于准确地定位及区别肺脓肿和有气液平的局限性脓胸，发现体积较小的脓肿和葡萄球菌肺炎引起的肺气囊，并有助于体位引流和外科手术治疗。